某医师给住院患者开具了药物医嘱后，很快发现自己的医嘱有误，但判断其不会给患者造成严重后果。此时该医师的最佳做法是
A. 失误不会造成严重后果，可隐瞒以避免纠纷
B. 不告知患者失误的实情，后续治疗中适当弥补
C. 不告知其他人，对患者进行密切观察
D. 纠正医嘱，并对出现的失误予以积极补救
E. 先不告知患者，若其知晓再为自己的失误辩护

正确答案：D。纠正医嘱，并对出现的失误予以积极补救

解析：不伤害原则是指医务人员在医疗行为中应尽量避免对患者造成生理及心理上的伤害，因此医务人员应尽可能提供最佳的诊疗措施去防范无意但是却可预知的伤害，把不可避免但可控的伤害控制在最低限度内。因为患者具有知情同意权，所以对于本题中某医生应遵循不伤害原则，不论会不会给患者造成严重后果，将情况告知患者并争取得其谅解，且纠正医嘱，并对出现的失误予以积极补救（D对）。